代谢性酸中毒时机体的代偿调节表现为
A. 肾小管K+-Na+交换减少；组织细胞内H+释出
B. 肾小管K+-Na+交换增强；组织细胞内H+释出
C. 肾小管K+-Na+交换减少；H+移入组织细胞内
D. 肾小管K+-Na+交换不变；H+移入组织细胞内
E. 肾小管K+-Na+交换增强；H+移入组织细胞内

正确答案：C。肾小管K+-Na+交换减少；H+移入组织细胞内

解析：代谢性酸中毒时H+通过离子交换方式进入细胞内被细胞内缓冲系统缓冲，而K+从细胞内向细胞外转移，所以肾小管内低钾，K+-Na+交换减少，故代谢性酸中毒时机体的代偿调节表现为肾小管K+-Na+交换减少；H+移入组织细胞内（C对）。